男性，35岁，劳力性呼吸困难，心悸，气短，少尿，下肢浮肿1年余，1周前咽痛、咳嗽、咯黄痰后呼吸困难加重，夜间不能平卧。超声心动图示，左右心室扩张，弥漫性运动不良，左心室射血分数30%。口服地高辛0.25mg，1次/d，既往无任何特殊病史。治疗时不应采用
A. 硝普钠
B. 消心痛
C. 速尿
D. 抗感染
E. 心脏移植

正确答案：E。心脏移植

解析：考虑是慢性心力衰竭的患者，心脏移植明显延长终末期心力衰竭患者的寿命，但是患者目前较年轻，症状也没有那么重，所以不选心脏移植。掌握“心力衰竭”知识点。